脊柱结核主要的X线表现是
A. 椎弓根骨质破坏和椎间隙正常
B. 椎体骨质增生和椎间隙狭窄
C. 脊柱竹节样改变
D. 椎体骨质破坏和椎间隙狭窄
E. 椎体骨质破坏和椎间隙增宽

正确答案：D。椎体骨质破坏和椎间隙狭窄

解析：脊柱结核主要的X线表现是椎体骨质破坏和椎间隙狭窄（D对）。椎弓根骨质破坏和椎间隙正常（A错）常见于脊柱肿瘤（P755），且多为转移性肿瘤。椎体骨质增生和椎间隙狭窄（B错）可见于骨关节炎（P761）。脊柱竹节样改变（C错）为强直性脊柱炎（P765）的典型表现。椎体骨质破坏和椎间隙增宽（E错）可见于化脓性脊椎炎（P745）。
①脊柱结核：椎体骨质破坏+椎间隙狭窄。 ②脊柱肿瘤：椎弓根骨质破坏+椎间隙正 常、多为转移性肿瘤。 ③骨关节炎：椎体骨质增生+椎间隙狭窄。 ④强直性脊柱炎：脊柱竹节样改变。 ⑤化脓性脊柱炎：骨质破坏+椎间隙增宽。